以下哪项与痛风无关
A. 过量饮酒
B. 超重及肥胖
C. 高嘌呤食物摄入过量
D. 遗传因素
E. 蛋白类食物

正确答案：D。遗传因素